《温病条辨》中提出，太阴风温、温热、温疫、冬温，初起但热不恶寒而渴者，主以
A. 白虎汤
B. 桂枝汤
C. 麻杏石甘汤
D. 银翘散
E. 清营汤

正确答案：D。银翘散

解析：风温、温热、温疫、冬温等4种温病初起，皆可表现为邪在肺卫。吴鞠通以“恶风寒”和“不恶寒”来区分使用辛温与辛凉之剂。恶风寒较明显者，是表邪偏盛，可借辛温之剂外散表邪，但不可过用辛温峻汗之剂，以免助热化燥。“但热不恶寒而渴”，用银翘散辛凉以疏解之（D对）。辛凉平剂银翘散是温病初起，邪在肺卫的代表方，是治疗温病上焦证的首方，用药以辛凉为主，稍佐辛温芳香之品，共成辛凉平和之剂。